灼伤可引起皮肤癌，说明口腔颌面肿瘤可能与哪项致病因素有关
A. 物理因素
B. 化学因素
C. 生物因素
D. 营养因素
E. 内分泌因素

正确答案：A。物理因素

解析：物理因素：如热、损伤、紫外线、X线及其他放射性物质，以及长期慢性刺激等因素。灼伤可引起皮肤癌。临床上可看到在瘢痕基础上发生的“瘢痕癌”。掌握“口腔颌面部肿瘤的概念、临床表现、诊断”知识点。